由于羰基的氧原子和碳原子之间因电负性差异，导致电子在氧和碳原子之间的不对称分布，在与另一个极性羰基之间产生静电相互作用，这种键合类型是
A. 共价键键合
B. 范德华力键合
C. 偶极-偶极相互作用键合
D. 疏水性相互作用键合
E. 氢键键合

正确答案：C。偶极-偶极相互作用键合

解析：本题考查偶极-偶极相互作用键合。由于羰基的氧原子和碳原子之间因电负性差异，导致电子在氧和碳原子之间的不对称分布，在与另一个极性羰基之间产生静电相互作用，这种键合类型是偶极-偶极相互作用键合（C对）。共价键键合（A错）是两个或两个以上原子共用电子对形成的键合形式，是不可逆的结合形式。范德华引力（B错）一般指分子间作用力，即存在于中性分子或原子之间的一种弱碱性的电性吸引力。疏水性相互作用（D错）是通过疏水物的疏水基与水相互排斥作用而发生的。氢键（E错）的生成是由于药物分子中含有孤对电子的O，N，S等原子和与非碳的杂原子以共价键相连的氢原子之间形成的弱化学键。